胃气上逆之呕吐、噫气，宜用
A. 石决明
B. 牡蛎
C. 龙骨
D. 珍珠
E. 代赭石

正确答案：E。代赭石

解析：代赭石苦，寒；入肝、心、肺、胃经。可平肝潜阳，重镇降逆，凉血止血。为重镇降逆之要药，尤善将上逆之胃气而具止呕、止呃、止噫之效（E对）。用治胃气上逆之呕吐、呃逆、噫气不止，常与旋覆花、半夏、生姜等药同用，如旋覆代赭汤；长于镇潜肝阳，清降肝火，为重镇潜阳常用之品；可降上逆之肺气而平喘；入心肝血分，有凉血止血之效；质重又善于降气、降火，故尤适宜于气火上逆，迫血妄行之出血证。